在传染病预防控制中，不属于疾病预防控制机构的职责是
A. 收集、分析和报告传染病监测信息
B. 对传染病疫情进行流行病学调查
C. 对传染病进行实验室检测、诊断、病原学鉴定
D. 对传染病人进行医学观察、紧急救治和转诊
E. 开展健康教育、咨询，普及传染病防治知识

正确答案：D。对传染病人进行医学观察、紧急救治和转诊